化学毒物的蓄积系数是
A. 多次染毒使全部动物死亡的累积剂量/一次染毒使全部动物死亡的剂量的比
B. 一次染毒使全部动物死亡的剂量/多次染毒使全部动物死亡的累积剂量
C. 多次染毒使半数动物死亡的累积剂量/一次染毒使半数动物死亡的剂量
D. 一次染毒使半数动物死亡的剂量/多次染毒使半数动物死亡的累积剂量

正确答案：C。多次染毒使半数动物死亡的累积剂量/一次染毒使半数动物死亡的剂量

解析：本题考查化学毒物的蓄积系数。化学毒物的蓄积系数是指多次染毒使半数动物死亡的累积剂量/一次染毒使半数动物死亡的剂量（C对ABD错）。